贫血脾胃虚弱证，治疗首选的方剂是
A. 香砂六君子汤合当归补血汤
B. 归脾汤
C. 八珍汤合无比山药丸
D. 化虫丸合八珍汤
E. 桃红四物汤

正确答案：A。香砂六君子汤合当归补血汤

解析：脾胃虚弱证症状表现为面色萎黄，口唇色淡，爪甲无泽，神疲乏力，食少便溏，恶心呕吐，舌质淡，苔薄腻，脉细弱。治法采用健脾和胃，益气养血。方剂应用香砂六君子汤合当归补血汤（A对）。归脾汤主治心脾两虚气血虚弱症倦怠乏力，头晕目眩，心悸失眠，少气懒言等（B错）。八珍汤合无比山药丸治疗脾肾阳虚症见面色苍白，形寒肢冷，腰膝酸软，神倦耳鸣，唇甲淡白，或周身浮肿，甚则腹水，舌质淡或有齿痕，脉沉细（C错）。化虫丸合八珍汤主治虫积证：面色萎黄少华，腹胀，善食易饥，恶心呕吐，或有便溏，嗜食生米、泥土、茶叶等，神疲肢软，气短头晕，舌质淡，苔白，脉虚弱（D错）。桃红四物汤以治疗血瘀为主，方中以强劲的破血之品桃仁、红花为主，力主活血化瘀；以甘温之熟地、当归滋阴补肝、养血调经；芍药养血和营，以增补血之力；川芎活血行气、调畅气血，以助活血之功（E错）。